下列消毒灭菌法哪种是错误的
A. 牛奶——巴氏消毒
B. 排泄物——漂白粉
C. 玻璃器材——流通蒸汽法
D. 含糖培养基——间歇灭菌法
E. 人或动物血清——滤过除菌

正确答案：C。玻璃器材——流通蒸汽法